男性，8岁，右手烧伤，有较大水疱，剧痛，在现场急救中，为减轻疼痛，最恰当的方法是
A. 安慰和鼓励受伤者
B. 肌注地西泮（安定）
C. 肌注哌替啶（杜冷丁）
D. 抽吸水疱
E. 将手浸入冷水中

正确答案：E。将手浸入冷水中

解析：患者右手烧伤，有水疱，剧痛，可诊断为浅Ⅱ度烧伤。小面积烧伤现场急救时，可立即用清水连续冲淋或浸泡（E对），既可消除致伤原因、减轻疼痛，又可带走余热，防止热力继续作用于创面使其加深。安慰和鼓励受伤者（A错）的效果一般欠佳。疼痛剧烈者可酌情肌注地西泮（安定）（B错）或肌注哌替啶（杜冷丁）（C错），但一般不作首选方案。抽吸水疱（D错）为浅Ⅱ度烧伤入院后的处理。